“一源三歧”是指
A. 冲脉胞脉带脉
B. 任脉冲脉
C. 督脉任脉带脉
D. 胞脉胞络冲脉
E. 冲脉任脉督脉

正确答案：E。冲脉任脉督脉

解析：冲脉、任脉、督脉（E对）皆起于胞中，同出于会阴，而后，再分别循行于人体的前后正中线和腹部两侧，故被形象称为“一源三岐”。